全身最坚硬的部位是
A. 牙质
B. 釉质
C. 牙骨质
D. 牙髓
E. 牙龈

正确答案：B。釉质

解析：釉质(B对)为人体全身最坚硬的组织。